有关可摘局部义齿的大连接体作用，说法错误的是
A. 连接义齿各部分成一整体
B. 传递和分散（牙合）力至基牙
C. 防止义齿翘起、摆动、旋转、下沉
D. 减少基牙在功能状态时所承受的扭力
E. 可减小基托面积，并可增加义齿的强度

正确答案：C。防止义齿翘起、摆动、旋转、下沉

解析：大连接体的作用：连接义齿各部分成一整体，传递和分散（牙合）力至基牙和邻近的支持组织，以减少基牙在功能状态时所承受的扭力和负荷；可减小基托面积，并可增加义齿的强度。掌握“局部义齿连接体”知识点。